男性，20岁，突然寒战，高热咳嗽，咳少量黏液痰，时有铁锈色痰，下列哪种疾病可能大
A. 支气管炎，继发感染
B. 病毒性肺炎
C. 支原体肺炎
D. 肺炎球菌肺炎
E. 肺炎杆菌肺炎

正确答案：D。肺炎球菌肺炎

解析：青年男性，突发寒战、高热咳嗽、咳少量黏液痰，时有铁锈色痰（大叶性肺炎的典型表现），考虑最可能的诊断为大叶性肺炎，主要由肺炎球菌引起（D对），好发于青壮年，男性多见，急骤起病临床主要表现为高热、寒战、咳嗽、血痰及胸痛。支气管炎（A错）年老体弱者易感，症状主要为咳嗽和咳痰，常发生于寒冷季节或气候突变时，也可由急性上呼吸道感染迁延不愈所致。病毒性肺炎（B错）好发于病毒性疾病流行季节，症状通常较轻，但起病较急，发热、头痛、全身酸痛、倦怠等全身症状较突出。支原体肺炎（C错）起病缓慢，起初无症状，继而乏力、头痛咽痛、肌肉酸痛，咳嗽明显，多为发作性干咳，夜间为重，也可产生脓痰，持久的阵发性剧咳为支原体肺炎较为典型的表现。肺炎杆菌肺炎（E错）是革兰阴性杆菌感染引起的肺炎，大多是克雷伯母杆菌，多见于老年人，症状主要是脓痰，咳嗽，胸痛，发热，畏寒怕冷，出虚汗，恶心，呕吐等症状。